有关巨细胞性龈瘤说法错误的是
A. 前牙区多见
B. 上颌较下颌多
C. 不发生于青年人
D. 女性较男性多见
E. 又称外周性巨细胞肉芽肿

正确答案：C。不发生于青年人

解析：本题考查巨细胞性龈瘤。有关巨细胞性龈瘤说法错误的是不发生于青年人（C错，为本题正确答案）。巨细胞性龈瘤：又称外周性巨细胞肉芽肿。较为少见，以30～40岁多见，也可发生于青年人和老年人。部位以前牙区多见，上颌较下颌多，位于牙龈或牙槽黏膜。女性较男性多见。包块有蒂或无蒂，呈暗红色，可发生溃疡。病变发生在牙间区者，颊和舌侧肿物与牙间狭窄带相连形成一种时漏状外观。